临床上常用于缓解子痫、破伤风等惊厥的药物是
A. 乙琥胺
B. 苯妥英钠
C. 卡马西平
D. 硫酸镁
E. 扑米酮

正确答案：D。硫酸镁